判断慢性胃炎有无活动的病理学依据是
A. 浆细胞浸润
B. 淋巴细胞浸润
C. 淋巴滤泡形成
D. 中性粒细胞浸润
E. 肠上皮化生

正确答案：D。中性粒细胞浸润

解析：慢性胃炎炎症的活动性是指中性粒细胞出现，它存在于固有膜、小凹上皮和腺管上皮之间，严重者可形成小凹脓肿。故中性粒细胞浸润是判断慢性胃炎有无活动的病理学依据（D对）。浆细胞浸润、淋巴细胞浸润是慢性炎症的表现，淋巴滤泡形成、肠上皮化生为慢性胃炎可出现的组织学变化，但它们都不是判断慢性胃炎有无活动的病理学依据（ABCE错）。